输尿管壁内段长约
A. 0-2.0cm
B. 3cm
C. 0cm
D. 0.5-2.0cm
E. 3-5cm

正确答案：D。0.5-2.0cm

解析：输尿管壁内部长约 1. 5cm（D对）。